宗气是
A. 行于脉外的气
B. 行于脉中的气
C. 藏于肾中之气
D. 积聚于胸中之气
E. 吸入肺中之气

正确答案：D。积聚于胸中之气

解析：宗气是由谷气与自然界清气相结合而积聚于胸中的气，属后天之气的范畴（D对）。卫气是行于脉外而具有保卫作用的气。卫气来源于脾胃运化的水谷精微。水谷之精化为水谷之气，其中剽悍滑利部分化生为卫气（A错）。营气是行于脉中而具有营养作用的气，营气性质精纯（B错）。